下列措施中哪个属于一级预防
A. 健康检查
B. 遗传咨询
C. 产前检查
D. 筛检

正确答案：B。遗传咨询

解析：本题考查一级预防。第一级预防又称病因预防，是在疾病（或伤害）尚未发生时针对病因或危险因素采取措施，降低有害暴露的水平，增强个体对抗有害暴露的能力，预防疾病（或伤害）的发生，或至少推迟疾病的发生。遗传咨询（B对）属于一级预防措施。健康检查（A错）、产前检查（C错）、筛检（D错）属于二级预防措施。